男，60岁。活动时胸骨后疼痛，胸骨右缘第2肋间可闻及4/6级收缩期喷射样杂音。最可能的诊断是
A. 主动脉瓣关闭不全
B. 二尖辦狭窄
C. 主动脉瓣狭窄
D. 二尖瓣关闭不全
E. 肺动脉瓣狭窄

正确答案：C。主动脉瓣狭窄

解析：患者老年男性，活动时胸骨后疼痛（提示心绞痛），胸骨右缘第2肋间（主动脉瓣区）可闻及4/6级收缩期喷射样杂音（主动脉瓣狭窄典型杂音），最可能的诊断是主动脉瓣狭窄（C对）。主动脉瓣关闭不全（P299）（A错）多有心悸、心前区不适、头颈部强烈动脉搏动感等，其典型杂音为主动脉瓣区（胸骨右缘第二肋间）舒张期高调递减型叹气样杂音。二尖瓣狭窄（B错）多有呼吸困难、咳嗽、咯血等肺淤血表现，其特征性的杂音为心尖区舒张中晚期隆隆样杂音。二尖瓣关闭不全（P292）（D错）心尖可触及抬举样搏动，典型杂音为心尖区全收缩期吹风样杂音。肺动脉瓣狭窄（P275）（E错）典型的心脏杂音为胸骨左缘第二肋间响亮的收缩期喷射样杂音。